下列哪些因素可能影响药效
A. 药物的脂水分配系数
B. 药物与受体的亲和力
C. 药物的解离度
D. 药物的电子密度分布
E. 药物形成氢键的能力

正确答案：A、B、C、D、E。药物的脂水分配系数；药物与受体的亲和力；药物的解离度；药物的电子密度分布；药物形成氢键的能力